关于卵巢性激素，正确的是
A. 孕激素有促进水钠潴留作用，雌激素则促进水钠排泄
B. 孕激素使宫颈黏膜分泌增加，性状变稀薄
C. 孕激素可使基础体温在排卵后升高0.3℃～0.5℃
D. 雌激素使增生期子宫内膜转化为分泌期内膜
E. 雄激素主要由颗粒细胞分泌，促进乳房发育

正确答案：C。孕激素可使基础体温在排卵后升高0.3℃～0.5℃

解析：孕激素兴奋下丘脑体温调节中枢，可使基础体温在排卵后升高0.3℃～0.5℃(C对）。雌激素促进促进水钠储留，孕激素促进水钠排泄（A错）。雌激素使宫颈口松弛、扩张，宫颈粘液分泌增加，性状变稀薄，富有弹性，易拉成丝状；孕激素使宫口闭合，粘液分泌减少性状变粘稠（B错）。雌激素使子宫内膜腺体和间质增生、修复；孕激素使增生期子宫内膜转化为分泌期内膜，为受精卵着床做好准备（D错）。雌激素主要由颗粒细胞分泌，促进乳房发育，女性雄激素主要由肾上腺皮质网状带细胞分泌（E错）。